古希腊医师希波克拉底认为医学有两件东西可以治病,一是语言二是药物，希波克拉底说这句话时处于什么医学模式
A. 生物医学模式
B. 生物心理社会医学模式
C. 自然哲学医学模式
D. 神灵医学模式
E. 机械医学模式

正确答案：C。自然哲学医学模式

解析：以希波克拉底为代表的最主要的古希腊医学派别立足千从物质性、整体性上说明疾病提出了著名的“四体液病因说”，但也强调“疾病是一种服从自然法则的过程”，在治疗原则上重视精神疗法，是受到自然哲学的影响，故希波克拉底说这句话时处于自然哲学医学模式（C对）。